生存曲线下降的坡度越陡，表示
A. 生存时间越短
B. 生存时间越长
C. 生存概率越大
D. 与生存时间无关
E. 以上均不是

正确答案：A。生存时间越短

解析：本题考查生存曲线的相关内容。生存曲线是以观察（随访）时间为横坐标，以生存率为纵坐标，将各个时间点所对应的生存率连接在一起的曲线图。生存曲线下降的坡度越陡，表示生存时间越短（A对BCDE错）。